具有吡喃醛糖结构的有
A. L-鼠李糖
B. D-果糖
C. D-葡萄糖醛酸
D. D-半乳糖醛酸
E. L-阿拉伯糖

正确答案：A、E。L-鼠李糖；L-阿拉伯糖

解析：本题考查的是单糖的构型。具有吡喃醛糖结构的有L-鼠李糖（A对）、L-阿拉伯糖（E对）。单糖是组成低聚糖和多聚糖的基本单位。多数单糖可以以开链及环状两种结构形式存在，如葡萄糖在固体状态时是环状结构，在溶液中则两种形式同时存在并可以互相转化，但主要以环状形式存在。自然界的糖多以五元、六元氧环的形式存在，五元氧环的糖称为呋喃型糖，六元氧环的糖称为呲喃型糖。五碳醛糖常见的有D-木糖、L-阿拉伯糖和D-核糖。甲基五碳糖亦称为6-去氧糖。常见的有L-夫糖、D-鸡纳糖和L-鼠李糖。